关于股骨头韧带的描述，何者错误
A. 一端跗于髋臼横韧带
B. 另一端跗于股骨头凹
C. 其内有营养股骨头的血管通行
D. 在关节腔内
E. 属囊内韧带

正确答案：D。在关节腔内

解析：股骨头韧带一端连于股骨头凹（B对），一端连于髋臼横韧带（A对），内有营养股骨头的血管通行（C对）。股骨头韧带位于关节囊内，属于囊内韧带（E对）。股骨头韧带不在关节腔内（D错，为本题正确答案），关节腔是关节囊滑膜层和关节面共同围成的密闭腔隙，内仅含有少量滑液。